与血的循行关系密切的脏腑是
A. 肺脾肾
B. 肝心肾
C. 肺肝脾
D. 心肺肝脾
E. 肝脾肾

正确答案：D。心肺肝脾

解析：血液的正常运行，与心、肺、肝、脾等脏腑的生理机能密切相关。心主血脉，心气推动和调控血液在脉中运行全身；肺朝百脉，主治节，辅助心脏主管全身血脉；肝主疏泄，调畅气机，是保证血行通畅的一个重要环节；脾主统血，脾气健旺则能控摄血液在脉中运行，防止血逸脉外（D对ABCE错）。